具有辛开苦降，补泻兼施特点的方剂是
A. 半夏泻心汤
B. 半夏厚朴汤
C. 吴茱萸汤
D. 左金丸
E. 小陷胸汤

正确答案：A。半夏泻心汤

解析：半夏泻心汤方中以辛温之半夏为君，散结除痞，又善降逆止呕。臣以辛热之干姜温中散寒，以苦寒之黄芩、黄连泄热开痞。君臣相伍，寒热平调，辛开苦降。然寒热互结，又缘于中虚失运，升降失常，故以人参、大枣甘温益气，以补脾虚，为佐药。甘草补脾和中而调诸药，为佐使药。诸药相伍，使寒去热清，升降复常，则痞满可除，呕利自愈（A对）。半夏厚朴汤配伍特点：辛苦行降，痰气并治，行中有宣，降中有散（B错）。吴茱萸汤配伍特点：肝肾胃三经同治，温降补三法并施，以温降为主（C错）。左金丸配伍特点：辛开苦降，肝胃同治；寒热并用，主以苦寒（D错）。小陷胸汤配伍特点：苦辛润相合，辛开苦降，润燥相得，消痰除痞，药简效专（E错）。